讲话者要让对方能听懂并理解自己的话是以下哪种人际传播技巧
A. 问话技巧
B. 听话技巧
C. 反馈技巧
D. 说话技巧
E. 动作技巧

正确答案：D。说话技巧